处方一般不得超过几日用量
A. 1天
B. 3天
C. 7天
D. 10天
E. 15天

正确答案：C。7天

解析：处方一般不得超过7日用量。掌握“处方的开具、监督管理及法律责任”知识点。